需延长作用时间的药物可采用的注射途径是
A. 皮内注射
B. 皮下注射
C. 动脉注射
D. 静脉注射
E. 关节腔注射

正确答案：B。皮下注射

解析：本题考查皮下注射。需延长作用时间的药物可采用的注射途径是皮下注射（B对）；皮下组织血管较少及血流速度比肌肉组织慢。一些需延长作用时间的药物可采用皮下注射；皮内注射（A错）只用于诊断与过敏试验；动脉内注射（C错）将药物或诊断药直接输入靶组织或器官；药物不宜口服、皮下或肌内注射，需迅速发生药效时，可采用静脉注射（D错）；关节腔注射（E错）是关节腔穿刺技术的一种延伸，以膝关节为例，膝关节关节腔积液以后，通常采取膝关节腔穿刺术将里面的积液抽出，同时给予关节腔内注药。